暴露组的发病率或死亡率与对照组同种率之比
A. 率比（RR）
B. 优势比（OR）
C. 人时发病率
D. 归因危险度
E. 病因分值

正确答案：A。率比（RR）

解析：本题考查相对危险度的概念。相对危险度（RR）通常包括了危险度比或率比。危险度比是暴露组的危险度（测量指标是累积发病率）与对照组的危险度之比。率比（A对BCDE错）是暴露组与对照组的发病密度之比。危险度比和率比都是反映暴露与发病（死亡）关联强度的最有用的指标。